隐裂发生最多的牙齿是
A. 上颌前磨牙
B. 下颌第一磨牙
C. 上颌第一磨牙
D. 下颌第二磨牙
E. 上颌第二磨牙

正确答案：C。上颌第一磨牙

解析：本题考查牙隐裂的好发牙齿。隐裂发生最多的牙齿是上颌第一磨牙（C对）。牙隐裂是指发生在牙冠表面的细小、不易发现的、非生理性的细小裂纹。以第一磨牙好发，其次是上下颌第二磨牙（DE错）和前磨牙（A错）。上下第一磨牙中，因上颌第一磨牙承受的（牙合）力大及其解剖因素等原因，隐裂最多发于上颌第一磨牙（C对B错）。